属于第二类溶剂的是
A. 乙醇
B. 甲醇
C. 聚乙二醇
D. 三氯甲烷
E. 四氯化碳

正确答案：B。甲醇

解析：本题考查溶剂分类。第二类溶剂是应限制使用的溶剂，一般具有非基因毒性，不可逆或可逆毒性。如甲苯、甲醇（B对）、正己烷、环己烷、吡啶、四氢呋喃、乙腈、DMF、DCM、氯仿、二氧六环、乙二醇、吡啶、硝基甲烷。